善驱绦虫，但因驱虫成分蛋白酶受热（60℃左右）后被破坏而失效，故驱绦虫时应研末冲服的药是
A. 雷丸
B. 榧子
C. 贯众
D. 南瓜子
E. 鹤草芽

正确答案：A。雷丸

解析：本题考查的是雷丸的使用注意。善驱绦虫，但因驱虫成分蛋白酶受热（60℃左右）后被破坏而失效，故驱绦虫时应研末冲服的药是雷丸（A对）。雷丸：【使用注意】本品苦寒，脾胃虚寒者慎服。其杀虫成分为蛋白酶，受热（60℃左右）或酸作用下易被破坏失效，而在碱性环境中使用则作用最强，故入煎剂无驱绦虫作用。榧子（B错）：【使用注意】本品甘润滑肠，故不宜过量使用，肺热痰咳者忌服。贯众（C错）：【使用注意】本品苦寒有小毒，故孕妇及脾胃虚寒者慎服。南瓜子（D错）：【主治病证】绦虫病，蛔虫病，钩虫病，血吸虫病。鹤草芽（E错）：【使用注意】部分患者服药后有轻度恶心呕吐的反应。